丁某，患肺结核1年有余，曾予化疗药物治疗。现症见咳嗽无力，气短声低，咳痰清稀，色白，量较多，偶或咯血，血色淡红，午后潮热，伴有畏风怕冷，自汗与盗汗并见，纳少神疲，便溏，面白，舌质光淡，边有齿印，苔薄，脉细弱而数。其中医证型是
A. 肺阴亏损证
B. 阴虚火旺证
C. 气阴耗伤证
D. 阴阳两虚证
E. 肺气亏虚证

正确答案：C。气阴耗伤证

解析：气阴耗伤证症状：咳嗽无力，气短声低，咳痰清稀色白量多，偶或带血，或咯血，血色淡红，午后潮热，伴有畏风怕冷，自汗盗汗，纳少神疲，便溏，面色㿠白，舌质淡，边有齿印，苔薄，脉细弱而数（C对）。肺阴亏损证症状：干咳，或痰中有血丝，或胸部隐痛，手足心热，皮肤干灼，口咽干燥，盗汗，舌边尖红，无苔或少苔，脉细或细数（A错）。阴虚火旺证症状：咳嗽气急，痰少黏稠或少量黄痰，时时咳血，血色鲜红，低热或午后潮热，五心烦热，骨蒸颧红，盗汗量多，心烦失眠，或见男子梦遗失精，女子月经不调，形体日渐消瘦，舌红绛而干，无苔或剥苔，脉细数（B错）。